环境污染物对人体健康产生慢性危害的根本原因是
A. 低浓度的环境污染物对机体损害的逐渐积累
B. 环境污染物的毒性高
C. 环境污染物之间的联合作用
D. 低浓度的环境污染物可经口吸收
E. 低浓度的环境污染物可经呼吸道吸收

正确答案：A。低浓度的环境污染物对机体损害的逐渐积累

解析：本题考查环境污染物对人体健康产生慢性危害的根本原因。环境污染物对人体健康产生慢性危害的根本原因是低浓度的环境污染物在机体内的物质或功能蓄积（A对BCDE错）。